有关嵌入剂的概念正确的是
A. 以静电吸附形式嵌入
B. 嵌入多核苷酸链之间
C. 导致移码突变
D. 以上都对

正确答案：D。以上都对

解析：本题考查嵌入剂。嵌入剂是指以静电吸附形式嵌入DNA单链的碱基之间或DNA双螺旋结构的相邻多核苷酸链之间，诱发移码突变的致突变物（D对ABC错）。